以下哪项不是手动不锈钢器械从尖端到柄的距离规格
A. 16mm
B. 21mm
C. 25mm
D. 28mm
E. 31mm

正确答案：A。16mm

解析：器械的长度：从尖端到柄的距离可分别为21、25、28、31mm，但工作端长度均为16mm。掌握“髓腔进入与初预备”知识点。